属于标准的圆环卡环，应用最为广泛，卡环的固位、支持和稳定作用均好的卡环
A. 圈形卡环
B. 回力卡环
C. 对半卡环
D. RPI卡坏
E. 三臂卡环

正确答案：E。三臂卡环

解析：三臂卡环：多用于牙冠外形好，无明显倾斜的基牙。卡环由颊、舌两个卡环臂和（牙合）支托组成，包绕基牙的3个或4个轴面角，小连接体和（牙合）支托连接，属于标准的圆环卡环，应用最为广泛，卡环的固位、支持和稳定作用均好。掌握“局部义齿固位体”知识点。